在踝区，外踝尖直下，外踝下缘与跟骨之间凹陷中的腧穴是
A. 商丘
B. 丘墟
C. 照海
D. 申脉
E. 然谷

正确答案：D。申脉

解析：申脉定位在踝区，外踝尖直下，外踝下缘与跟骨之间凹陷中（D对）。商丘穴定位在内踝前下方凹陷中，当舟骨结节与内踝尖连线的中点处（A错）。丘墟定位在外踝前下方，指长伸肌腱的 外侧凹陷中（B错）。照海定位在内踝高点正下缘凹陷处（C错）。然谷定位在内踝前下方，足舟骨粗隆下缘凹陷中（E错）。